药学专业期刊登载的研究论文属于
A. 一级文献
B. 二级文献
C. 三级文献
D. 常见数据库文献
E. 药学文献

正确答案：A。一级文献

解析：本题考查药物信息的分类。药学专业期刊登载的研究论文属于一级文献（A对）。二级文献（B错）为二级信息资源。三级文献（C错）为三级信息资源。常见中文文献数据库（D错）有维普、万方和中国知网等，常见外文文献数据库有SpringerLink、Pubmed、Embase等。记录着有关药学知识的一切载体即称为药学文献（E错）。